关于β受体阻断剂用于冠状动脉粥样硬化性心脏病治疗的说法，错误的是
A. 可减少心绞痛发作，提高运动耐量
B. 应作为稳定型心绞痛的初始治疗药物
C. 使用剂量应个体化
D. 是变异型心绞痛的首选治疗药物
E. 支气管哮喘急性发作期禁用

正确答案：D。是变异型心绞痛的首选治疗药物

解析：本题考查β受体阻断剂。变异型心绞痛，不宜使用β受体阻断剂（D错，为本题正确答案），CCB是首选药物。如无禁忌症，β受体阻断剂应作为稳定型心绞痛的初始治疗药物（B对）。β受体阻断剂抑制心脏β肾上腺素能受体，从而减慢心率、减弱心肌收缩力、降低血压，减少心肌耗氧量和心绞痛发作，增加运动耐量；通过延长舒张期以增加缺血心肌灌注，因而可以减少心绞痛发作和提高运动耐量（A对）。β受体阻断剂的使用剂量应个体化（C对），其使用方法应由较小剂量开始，逐渐增加，当达到上述静息心率时维持当前剂量。支气管哮喘急性发作期禁用（E对）β受体阻断剂。